长期应用糖皮质激素治疗，停药时应注意
A. 检查病人血细胞
B. 了解胃粘膜有无损伤
C. 补充蛋白质
D. 服用抗糖皮质激素药物
E. 逐次减量停药

正确答案：E。逐次减量停药

解析：长期应用糖皮质激素治疗，可反馈性抑制垂体－肾上腺皮质轴致肾上腺皮质萎缩，若突然减药或减量过快，可引起肾上腺功能不全或危象，表现为恶心、呕吐、乏力、低血压和休克等，需要及时抢救，故须逐次减量停药（E对）。